表示单位时段开始时存活的个体，到该时段结束时仍存活的可能性
A. 死亡概率
B. 生存率
C. 生存概率
D. 生存时间
E. 中位生存时间

正确答案：C。生存概率

解析：本题考查生存概率的概念。生存概率（C对ABDE错）是指某时段开始时存活的个体，到该时段结束时仍存活的可能性。